以下不可以出现在牙髓坏死中的是
A. 有自发痛史
B. 外伤史
C. 正畸史
D. 充填、修复史
E. 明显自觉症状

正确答案：E。明显自觉症状

解析：牙髓坏死无自觉症状。可有自发痛史、外伤史、正畸史或充填、修复史等。掌握“牙髓坏死、牙髓钙化与牙内吸收”知识点。